奥美拉唑的主要作用机制是
A. 阻断H₂受体
B. 中和胃酸
C. 灭活H⁺，K⁺-ATP
D. 促进胃黏液分泌
E. 覆盖于胃黏膜上，阻断胃酸作用

正确答案：C。灭活H⁺，K⁺-ATP

解析：本题考查奥美拉唑的作用机制。奥美拉唑为质子泵抑制剂，通过抑制质子泵（H⁺，K⁺-ATP酶）的活性来抑制胃酸分泌（C对）；抗酸剂服后在胃内中和胃酸（B错），并能形成保护膜，覆盖于胃黏膜表面（E错）；H₂受体阻断剂（A错）能有效地抑制夜间基础胃酸分泌，降低胃酸与胃蛋白酶活性；胃黏膜保护剂能够增加胃黏膜细胞黏液（D错）、碳酸氢盐的分泌，增加黏液层的疏水性。